关于脑死亡标准的制定和实施，下列说法中不正确的是
A. 有利于节约卫生资源
B. 有利于减轻家属的负担
C. 有利于维护死者的尊严
D. 有利于开展器官移植
E. 有利于减少“植物人”的数量

正确答案：E。有利于减少“植物人”的数量